女，30岁。体检发现胆囊结石2年。近期进食油腻食物后持续上腹痛，向右肩部放射，伴恶心、呕吐，休息后可自行缓解，症状反复发作。查体：上腹明显压痛，Murphy征可疑阳性，肋脊角无压痛、叩痛。诊断首先考虑为
A. 胆囊结石
B. 肾结石
C. 胃溃疡
D. 肠梗阻
E. 慢性胰腺炎急性发作

正确答案：A。胆囊结石

解析：青年女性，既往胆囊结石病史，近期进食油腻食物后持续上腹痛，向右部放射，伴恶心、呕吐，休息后可自行缓解（胆囊结石的典型表现），症状反复发作，查体：上腹明显压痛，Murphy征可疑阳性，肋脊角无压痛、叩痛（可排除肾结石），根据患者的病史、临床症状及体征，考虑最可能的诊断为胆囊结石（A对），肾结石（B错）主要症状是疼痛和血尿，且肋脊角会有压痛及叩痛。胃溃疡（C错）的典型症状虽也是上腹痛，但不会向右肩部放射，恶心呕吐也较少见。肠梗阻（D错）肠梗阻的主要临床表现是痛、吐、胀、闭与该患者的临床表现明显不符。慢性胰腺炎急性发作（E错）的腹痛常较剧烈，多位于中左上腹甚至全腹，部分病人腹痛向背部放射，病人病初可伴有恶心、呕吐，轻度发热。